移位明显的骨折需要
A. 保守治疗
B. 单颌固定
C. 颌间结扎
D. 切开复位内固定术
E. 暂不处理，随访

正确答案：D。切开复位内固定术

解析：开放复位坚强内固定的适应证为：多发性或粉碎性上、下颌骨骨折；全面部骨折；有骨缺损的骨折；大的开放性骨折；明显移位的上、下颌骨骨折；无牙颌及牙槽突萎缩的下颌骨骨折；感染的下颌骨骨折。掌握“牙槽突骨折、颌骨骨折”知识点。